属于Ic类抗心律失常药物的是
A. 奎尼丁
B. 利多卡因
C. 普罗帕酮
D. 胺碘酮
E. 维拉帕米

正确答案：C。普罗帕酮